9岁患儿，每晚睡前吃饼干，进来发现牙齿上有洞，但无疼痛感，前来就诊。医生将治疗情况描述为1，则表明
A. 不需处理
B. 修补1个面
C. 修补2个面
D. 修补3个面
E. 修补>3个面

正确答案：B。修补1个面